直接选择性抑制钠通道
A. 呋塞米
B. 乙酰唑胺
C. 氢氯噻嗪
D. 螺内酯
E. 氨苯蝶啶

正确答案：E。氨苯蝶啶